药品质量检验中，以一次检验结果为准、不宜复检的项目有
A. 鉴别
B. 无菌
C. 含量测定
D. 热原
E. 细菌内毒素

正确答案：B、D、E。无菌；热原；细菌内毒素

解析：本题考查药品质量检验。药品质量检验中，以一次检验结果为准、不宜复检的项目有无菌（B对）、热原（D对）、细菌内毒素（E对）、重量差异、装量差异等。检验不合格或处于临界值边缘的项目，除以上项目外，其余项目一般应予复检。鉴别（A错）和含量测定（C错）要复检。